患者，男，27岁。恶寒重，发热轻，头痛，鼻塞流清涕，周身痠楚疼痛，舌苔薄白而润，脉浮紧。治疗应首选
A. 三拗汤
B. 藿香正气散
C. 小青龙汤
D. 荆防败毒散
E. 新加香薷饮

正确答案：D。荆防败毒散

解析：患者以恶寒重，发热轻，头痛，鼻塞流清涕为主证，故诊断为感冒。风寒之邪外束肌表，卫阳被郁，故见恶寒，发热；清阳不展，脉络失和，则头痛，周身酸楚疼痛；风寒上受，肺气不宣而致鼻塞流清涕；舌苔薄白而润，脉浮紧俱为表寒征象。故诊断为感冒风寒束表证。需要辛温解表，用辛温发汗，疏风祛湿的荆防败毒散治疗。（D对）三拗汤是咳嗽风寒袭肺证的方剂。（A错）。藿香正气散是呕吐外邪犯胃证的方剂。（B错）。小青龙汤是哮病冷哮证的方剂。（C错）。新加香薷饮感冒暑湿伤表证的方剂。（E错）